癫痫患者，发则突然跌仆，目睛上视，口吐白沫，手足抽搐，喉间痰鸣，舌苔白腻，脉弦滑。治宜
A. 健脾和胃，化痰熄风
B. 补益肝肾，育阴熄风
C. 清热化痰，熄风定痫
D. 清肝泻火，化痰熄风
E. 涤痰熄风，开窍定痫

正确答案：E。涤痰熄风，开窍定痫

解析：此病为痫证，肝风内动，挟痰横窜，气血逆乱于胸中，心神失守，故突然跌扑，不省人事；内风窜扰筋脉，故目睛上视，口吐白沫，手足抽搐，喉间痰鸣；苔白腻主湿，脉弦滑为风痰内盛，故急以开窍醒神，后需涤痰熄风（E对），用黄连解毒汤和定痫丸加减。健脾和胃，化痰熄风（A错）适用于休止期的脾虚痰盛证用醒脾汤加减。补益肝肾，育阴熄风（B错）适用于休止期的肝肾阴虚证，用左归丸。清热化痰，熄风定痫（C错）适用于内蕴痰热之证。清肝泻火，化痰熄风（D错）适用于休止期的肝火痰热证，用龙胆泻肝汤合涤痰汤加减。